细菌性痢疾的传播途径是
A. 呼吸道
B. 消化道
C. 虫媒传播
D. 血液
E. 接触传播

正确答案：B。消化道

解析：本病主要通过粪～口途径经消化道（B对）传播。呼吸道（A错），血液（D错）不会传播；志贺菌随粪便排出体外，通过污染食物、水，或经苍蝇、蟑螂等媒介（C错）污染食物经口传播，虽经虫媒，但最终还是经过了粪～口途径；也可经密切接触（E错）患者或带菌者的生活用具而感染，接触患者一般不会感染。食物或水源受污染后可致暴发流行。